产后腹痛血虚证的治法是
A. 养血活血
B. 补血益气
C. 行气养血
D. 活血止痛
E. 活血化瘀，散寒止痛

正确答案：B。补血益气

解析：产后腹痛气血两虚，应补血益气，缓急止痛。血旺则子宫得以濡养，气旺则帅血以行，气通血荣，腹痛自除（B对）。养血活血多用于血少血瘀证（A错）。行气养血多用于气滞血少证（C错）。活血止痛可用于瘀血阻滞的病症（D错）。活血化瘀，散寒止痛可用于寒凝血瘀证（E错）。